现行的《中华人民共和国食品安全法》开始施行的时间是
A. 2001/10/1
B. 2009/2/28
C. 2009/6/1
D. 2010/1/1
E. 2015/10/1

正确答案：E。2015/10/1

解析：本题考查《中华人民共和国食品安全法》开始施行的时间。现行的《中华人民共和国食品安全法》开始施行的时间是2015年10月1日（E对ABCD错）。